咳声清扬伴鼻流清涕，应考虑是
A. 外感风热
B. 外感风寒
C. 阴虚肺燥
D. 百日咳
E. 咽炎

正确答案：B。外感风寒

解析：咳嗽是小儿常见的一种肺系病症，有声无痰为咳，有痰无声为嗽，有声有痰谓之咳嗽，分为外感咳嗽和内伤咳嗽。本证以咳嗽为主症，故诊断为咳嗽，伴鼻流清涕，提示风寒表证，为外感风寒咳嗽，由风夹寒邪，风寒束肺，肺气失宣所致（B对）。外感风热（A错）咳嗽其临床表现为咳痰不爽，痰黄黏稠，不易咯出。阴虚肺燥（C错）临床表现为干咳无痰，或痰少而粘，或痰中带血，不易咯出，。百日咳（D错）临床表现为咳嗽逐渐加重，呈典型的阵发性、痉挛性咳嗽，咳嗽终末出现深长的鸡啼样吸气性吼声。咽炎（E错）主要表现为咽部有异物感，咯不出，咽不下。